不属于典型世界食物结构模式的是
A. 中国膳食模式
B. 日本膳食模式
C. 东方膳食模式
D. 经济发达国家膳食模式
E. 地中海膳食模式

正确答案：A。中国膳食模式